其立体构型为苏阿糖型的手性药物是
A. 盐酸麻黄碱
B. 盐酸伪麻黄碱
C. 盐酸克仑特罗
D. 盐酸普萘洛尔
E. 阿替洛尔

正确答案：B。盐酸伪麻黄碱